《麻醉药品和精神药品管理条例》规定，区域性批发企业从定点生产企业购进麻醉药品和第一类精神药品，须经批准的部门是
A. 县级药品监督管理部门
B. 设区的市级药品监督管理部门
C. 省、自治区、直辖市人民政府药品监督管理部门
D. 国务院药品监督管理部门
E. 国务院卫生行政部门

正确答案：C。省、自治区、直辖市人民政府药品监督管理部门

解析：本题考查麻醉药品和精神药品购进渠道管理。《麻醉药品和精神药品管理条例》规定，区域性批发企业从定点生产企业购进麻醉药品和第一类精神药品，须经批准的部门是省、自治区、直辖市人民政府药品监督管理部门（C对）。麻醉药品和精神药品购进渠道管理：（1）全国性批发企业，应当从定点生产企业购进麻醉药品和第一类精神药品。（2）区域性批发企业，可以从全国性批发企业购进麻醉药品和第一类精神药品，区域性批发企业从定点生产企业购进麻醉药品和第一类精神药品制剂，须经所在地省级药品监督管理部门批准。（3）从事第二类精神药品批发业务的企业，可以从第二类精神药品定点生产企业、具有第二类精神药品经营资格的定点批发企业（全国性批发企业、区域性批发企业、其他专门从事第二类精神药品批发业务的企业）购进第二类精神药品。